关于骨软骨瘤临床表现的叙述，正确的是
A. X线检查可见骨膜反应
B. 一般无症状，生长缓慢的骨性突起
C. 肿物与周围界线不清
D. 生长较快，伴明显疼痛
E. 肿块明显，皮肤有静脉怒张

正确答案：B。一般无症状，生长缓慢的骨性突起

解析：骨软骨瘤是好发于长骨干骺端的良性肿瘤，一般无症状，多因在干骺端无意中发现生长缓慢的骨性突起肿块而就诊（B对）。良性肿瘤（P770）多无疼痛（D错），但有些良性肿瘤，如骨样骨瘤可因反应骨的生长而产生剧痛。肿块明显，皮肤有静脉怒张（反映肿瘤的血运丰富 ）多见于恶性肿瘤（P770）（E错）。